治疗久痹风、寒、湿偏盛不明显者，可选用的方剂是
A. 防风汤
B. 薏苡仁汤
C. 宣痹汤
D. 蠲痹汤
E. 乌头汤

正确答案：D。蠲痹汤

解析：痹证行痹风气盛，治宜祛风通络，散寒除湿，方选防风汤（A错）。痹证着痹湿气盛，治宜除湿通络，祛风散寒，方选薏苡仁汤（B错）。痹证风湿热痹风热之邪偏盛，治宜清热通络，祛风除湿，方选白虎加桂枝汤合宣痹汤（C错）。久痹风、寒、湿偏盛不明显者，首选蠲痹汤以祛风除湿，蠲痹止痛（D对）。痹证痛痹寒气盛，治宜散寒通络，祛风除湿，方选乌头汤（E错）。